某女，73岁。素患咳喘痰多。近日因天气潮湿，过食甘甜，又致湿阻中焦、脾胃气滞，症见脘腹胀满、纳呆，舌淡苔白腻，宜选用的药是
A. 厚朴
B. 茯苓
C. 佩兰
D. 草果
E. 草豆蔻

正确答案：A。厚朴

解析：本题考查的是厚朴的主治病证。素患咳喘痰多。近日因天气潮湿，过食甘甜，又致湿阻中焦、脾胃气滞，症见脘腹胀满、纳呆，舌淡苔白腻，宜选用的药是厚朴（A对）。厚朴：【主治病证】（1）湿阻中焦、脾胃气滞之脘腹胀满。（2）食积或便秘脘腹胀满。（3）咳喘痰多。茯苓（B错）：【主治病证】（1）小便不利，水肿，痰饮。（2）脾虚证，兼便溏或泄泻者尤佳。（3）心悸，失眠。佩兰（C错）：【主治病证】（1）湿阻中焦证。（2）湿热困脾。（3）暑湿及湿温初起。草果（D错）：【主治病证】（1）寒湿中阻证。（2）寒湿偏盛之疟疾。草豆蔻（E错）：【主治病证】（1）寒湿中阻之胀满疼痛。（2）寒湿中阻之呕吐、泄泻。